竞争性抑制胃肠道的α-葡萄糖苷酶活性，减慢肠道内多糖、寡糖或双糖的降解，从而延缓单糖的吸收，可降低餐后血糖的药物是
A. 二甲双胍
B. 吡格列酮
C. 伏格列波糖
D. 格列吡嗪
E. 利拉鲁肽

正确答案：C。伏格列波糖

解析：本题考查伏格列波糖。竞争性抑制胃肠道的α-葡萄糖苷酶活性，减慢肠道内多糖、寡糖或双糖的降解，从而延缓单糖的吸收，可降低餐后血糖的药物是伏格列波糖（C对）。治疗糖尿病的药物有：胰岛素、双胍类，如二甲双胍（A错）、胰岛素增敏剂，如吡格列酮（B错）、磺酰脲类，如格列吡嗪（D错）、非磺酰脲类促胰岛素分泌药、α-葡萄糖苷酶抑制剂，如阿卡波糖、胰高糖素样肽-1受体激动剂，如利拉鲁肽（E错）。